肺的通气/血流比值反映肺部气体交换时气泵和血泵的匹配情况。如果通气/血流比值增大，说明出现
A. 肺内气体交换障碍
B. 解剖无效腔增大
C. 肺泡无效腔增大
D. 解剖动静脉短路
E. 功能性动静脉短路

正确答案：C。肺泡无效腔增大